下列选项中，C类不良反应事件为
A. 青霉素引起过敏休克
B. 沙利度胺引起的致畸
C. 青霉素引起过敏休克
D. 吗啡引起依赖性
E. 异烟肼引起肝肾功能损伤

正确答案：B。沙利度胺引起的致畸

解析：本题考查药物不良反应的分类。按药物发生的不良反应机制分类，沙利度胺属于C型不良反应发生机制，致癌、致畸、致突变（B对）。